男，30岁。右下6金属全冠黏固1周后脱落，咬合时常有瞬间性疼痛。口腔检查见患者咬合紧，牙冠短，对颌牙面有银汞合金充填物，脱落的全冠完整。出现咬合时瞬间疼痛最可能的原因是
A. 牙髓炎
B. 根尖周炎
C. 金属微电流刺激
D. 牙周炎
E. 龈缘炎

正确答案：C。金属微电流刺激

解析：本题考查咬合时瞬间疼痛的原因。由于异种金属修复体接触会产生的微电流而引起自发痛，患者右下6为金属全冠修复体且口腔检查见患者对颌牙面有银汞合金充填，故有金属微电流刺激（C对）而出现咬合时瞬间疼痛。牙髓炎、根尖周炎、牙周炎（ABD错）在全冠粘固一周后常出现自发痛，而患牙为咬合瞬间疼痛，与题意不符。龈缘炎（E错）表现为修复体龈边缘处的龈组织充血、水肿、易出血、疼痛，与题意不符。